男性，42岁。运动时胸闷1周。体检：胸骨左缘第3～4肋间可闻及粗糙的喷射性收缩期杂音。心电图示Ⅱ、Ⅲ、aVF导联出现病理性Q波。超声心动图示室间隔流出道部分向左心室内突出，二尖瓣前叶在收缩期向前方运动。该患者最可能的诊断是
A. 室间隔缺损
B. 风湿性主动脉瓣狭窄
C. 肥厚型心肌病
D. 急性心肌梗死
E. 劳力型心绞痛

正确答案：C。肥厚型心肌病

解析：患者中年男性，运动时胸闷，体检：胸骨左缘第3～4肋间可闻及粗糙的喷射性收缩期杂音（提示流出道梗阻），心电图示Ⅱ、Ⅲ、aVF导联出现病理性Q波（少数肥厚型心肌病可出现），超声心动图示室间隔流出道部分向左心室内突出，二尖瓣前叶在收缩期向前方运动（SAM，肥厚型梗阻性心肌病典型的表现），根据患者的临床表现、体检和影像学检查可得该患者最可能的诊断是肥厚型心肌病（C对）。室间隔缺损（P273）（A错）虽然也可在胸骨左缘第3～4肋间闻及粗糙的喷射性收缩期杂音，但不会出现特异性的SAM征。风湿性主动脉瓣狭窄（P295）（B错）的典型表现为心绞痛、晕厥和心力衰竭三联征。急性心肌梗死（D错）多可在心尖区出现粗糙的收缩期杂音或伴收缩中晚期喀喇音。劳力性心绞痛（P219）（E错）的特点为阵发性的前胸压榨性疼痛或憋闷感觉，常发生于劳力负荷增加时，休息即可缓解。